患者，男，27岁。干咳少痰，咳声短促，痰中带血，五心烦热，时有盗汗，形体消瘦，胸部闷痛隐隐，舌红少苔，脉细数。其诊断是
A. 内伤咳嗽，肺阴亏耗
B. 肺痨，肺阴亏损
C. 哮证，肺虚
D. 喘证，肺虚
E. 虚劳，肺阴虚

正确答案：B。肺痨，肺阴亏损

解析：题中患者以干咳少痰，痰中带血，五心烦热、时有盗汗、形体消瘦为主症，故诊断为肺痨。干咳少痰，咳声短促，为痨虫蚀肺，阴津受损，阴虚肺燥，肺失滋润所致。肺损络伤，故痰中带血，胸部闷痛隐隐；阴虚生热，虚热内灼，故五心烦热，时有盗汗；阴虚津伤，不能充养形体，故形体消瘦；舌红少苔，脉细数均为阴虚之象，故辨为肺阴亏损证（B对）。内伤咳嗽肺阴亏耗证虽有干咳，痰中带血，但多无形体消瘦，胸部闷痛隐隐的特征（A错）。哮证喉中多有哮鸣音，且无五心烦热、盗汗、痰中带血，形体消瘦，胸部闷痛隐隐的症状（C错）。喘证肺虚证无五心烦热、盗汗、痰中带血，形体消瘦，胸部闷痛隐隐的症状（D错）。虚劳肺阴虚无咯痰，形体消瘦，胸部隐隐闷痛的症状（E错）。